针对焦虑症下列哪一种说法是错误的
A. 焦虑症的发作者有遗传基础
B. 焦虑症患者运动后血中乳酸较对照组高
C. 焦虑症患者有去甲肾上腺素能活动增加
D. 焦虑症的发生可能与5－羟色胺功能增高有关
E. 焦虑症患者的发病与脑内病毒感染有关

正确答案：E。焦虑症患者的发病与脑内病毒感染有关

解析：焦虑症患者的病因有：①遗传（A对）；②神经生物学因素：γ氨基丁酸系统、5-羟色胺系统（D对）、去甲肾上腺素系统（C对）；③心理相关因素，与脑内病毒感染并不相关（E错，为本题正确答案）。有国内资料发现广泛性焦虑和惊恐发作的患者其血乳酸水平均较正常对照组显著增高（B对）。